立意抽样又称为
A. 目的抽样
B. 雪球抽样
C. 方便抽样
D. 分层抽样
E. 定额抽样

正确答案：A。目的抽样

解析：本题考查立意抽样的别称。立意抽样又称为目的抽样（A对BCDE错）或判断抽样，由研究者根据研究目的，通过主观判断选择研究对象的抽样方法。